躁狂发作的睡眠障碍特点是
A. 多梦
B. 早醒
C. 睡眠浅
D. 睡眠需求减少
E. 入睡困难

正确答案：D。睡眠需求减少

解析：躁狂发作的睡眠障碍特点是睡眠需求减少（D对）。抑郁发作时，表现有多梦（A错）、早醒（B错）、睡眠浅（C错）及入睡困难（E错）等睡眠障碍（P196）。